女，30岁，开口受限1年，既往有关节弹响史。临床检查见开口度1指半，开口型左偏。首先应进行许勒位及升支侧位检查。关节结构为T形致密团块代替，不是颞下颌关节紊乱综合征的表现。平片及体层摄影检查发现颞下颌关节前间隙增宽，髁状突骨质未见异常，应进一步进行颞下颌关节造影检查。左侧颞下颌关节造影侧位体层闭口位，关节盘后带位于髁突横嵴前方，开口位见髁突前方的关节盘变形，似一肿块压迫造影剂的影像，应诊断为
A. 不可复性盘前移位
B. 关节肿瘤
C. 关节盘附着松弛
D. 关节盘内移位
E. 关节盘可复性前移位

正确答案：A。不可复性盘前移位

解析：本题考查颞下颌关节疾病-不可复性盘前移位。颞下颌关节造影检查的适应症主要为观察关节盘的位置和是否存在关节盘穿孔，不可复性盘前移位在关节下腔造影开口位片上显示前下隐窝造影剂不能完全回到后下隐窝。并可常见盘发生变形，类似一肿块压迫的影像.闭口位显示关节盘本体部向前明显超过正常位置，并移位于髁突顶前方。因此左侧颞下颌关节造影侧位体层闭口位，关节盘后带位于髁突横嵴前方，开口位见髁突前方的关节盘变形，似一肿块压迫造影剂的影像，应诊断为不可复性盘前移位（A对）。关节肿瘤（B错）表现为髁突处有新生物或结构破坏等。关节盘附着松弛（C错）往往伴有关节囊扩张，影像表现为各附着均松弛。关节盘内移位（D错）表现为过度充盈、增宽。关节盘可复性前移位（E错）开口位表现为基本正常的盘髁关系。